叩诊为“短而弱的高音”，推断叩诊器官是
A. 正常肺
B. 胃泡区和腹部
C. 肺气肿
D. 心肝被肺遮盖的部分
E. 肝脾等实质性器官

正确答案：E。肝脾等实质性器官

解析：“短而弱的高音”即实音。实音是一种音调较浊音更高，音响更弱，振动持续时间更短的一种非乐性音，为心肝脾等实质性器官（E对）的正常叩诊音。正常肺（A错）叩诊轻音。胃泡区和腹部（B错）叩诊鼓音。肺气肿（C错）叩诊过清音。心肝被肺遮盖的部分（D错）叩诊浊音。由鼓音、过清音、清音、浊音到实音，音调越来越高，响度越来越弱，振动持续时间越来越短。